中等深度以上龋，银汞合金充填时需垫底，其原因为银汞合金有
A. 牙髓刺激性
B. 流动性
C. 传导性
D. 膨胀性
E. 收缩性

正确答案：C。传导性

解析：本题考查银汞合金充填术。银汞合金是电和热的良导体，具有良好的传导性（C对），充填时需垫底以避免电或热传导至牙髓，刺激牙髓。银汞合金本身并没有牙髓刺激性（A错）。流动性（B错）、膨胀性（D错）、收缩性（E错）与银汞合金充填时需垫底并无关系。